吸烟与肺癌的关系研究中，RR＝2.1，95%的可信限为1.6～2.8，该结果说明
A. 吸烟者患肺癌的危险至少为不吸烟者的1.6倍
B. 暴露组的发病率与非暴露组的发病率差异具有统计学意义
C. 样本得出的相对危险度不太可靠，95%可信限比较寬
D. 暴露与疾病的发生无关
E. 暴露与疾病关联不明确

正确答案：B。暴露组的发病率与非暴露组的发病率差异具有统计学意义

解析：本题考查相对危险度的相关内容。相对危险度（RR）是指暴露组发病或死亡的危险是非暴露组的多少倍，即两组危险度之比。RR值越大，表明暴露的效应越大，暴露与结局关联的强度越大。说明暴露组的发病率与非暴露组的发病率差异具有统计学意义（B对ACDE错）。